人生会遇到无数应激源的作用，只有那些对人有意义的刺激物才能引起心理应激反应，这些事物是否对人有意义。很大程度上取决于
A. 应激源的强度
B. 应激源的性质
C. 应激源的数量
D. 人的认知评价
E. 人的智力水平

正确答案：D。人的认知评价

解析：首先，同一环境事件对某人可能有应激性，而对他人可能不具有应激性。大多数外部刺激不能绝对地被定义为具有应激性。个人的认知评价才使某一事件具有应激性。其次，同一个体在不同场景会把同一时间解释成具有应激性或不具有应激性。因为身体条件、情绪和动机等心理状态的不同而影响评价过程。事件本身是不具有应激性，只有当真的丧失和感到丧失或觉察并估价到一种威胁时才会变得具有应激性。由此提出了心理应激学说中的认知评价理论。掌握“心理应激”知识点。